肾的固定装置不健全时，肾可向哪个方向游走
A. 向内侧
B. 向外侧
C. 向上方
D. 向下方
E. 向后上方

正确答案：D。向下方

解析：肾筋膜具有固定肾脏的功能，位于肾前、后面的肾筋膜分别称为肾前筋膜和肾后筋膜，两者在肾的下方则互相分离，导致肾筋膜下方完全开放，当腹壁肌力弱、肾周脂肪少、肾的固定结构薄弱时，可产生肾下垂（D对）。